以下需要紧急溶栓的疾病为
A. 急性非ST段抬高型心肌梗死
B. 急性ST段抬高型心肌梗死
C. 稳定性心绞痛
D. 变异性心绞痛
E. 不稳定性心绞痛

正确答案：B。急性ST段抬高型心肌梗死

解析：急性ST段抬高型心肌梗死预计PCI大于120分钟，力争在10分钟内给予溶栓药物（B对）。急性非ST段抬高型心肌梗死（A错）、变异性心绞痛（D错）、不稳定性心绞痛（E错）的血栓为白色血栓，溶栓无效，稳定性心绞痛（C错）服用硝酸甘油即可缓解。